正气不足，邪气亢盛形成的病证是
A. 真虚假实证
B. 真实假虚证
C. 虚证
D. 实证
E. 虚实夹杂证

正确答案：E。虚实夹杂证

解析：本题考察基本病机中邪正盛衰与虚实变化。正虚为主，又兼有实邪为患的病机变化属于虚中夹实，那么正气不足，邪气亢盛所形成的病证就是虚实夹杂证（E对）。真虚假实证和真实假虚证是指在某些特殊情况下，疾病的临床症状可出现与其病机的虚实本质不符的假象（AB错）。实证指邪气盛，是以邪气亢盛为矛盾主要方面的病机变化；虚证指正气不足，是以正气虚损为矛盾主要方面的病机变化，与题干问题不符（CD错）